属手厥阴心包经的腧穴是
A. 尺泽
B. 曲泽
C. 曲池
D. 少海
E. 支沟

正确答案：B。曲泽

解析：该题考查手厥阴心包经的腧穴。曲泽为手厥阴心包经的合穴，定位在肘横纹中，肱二头肌腱尺侧缘（B对）。尺泽为手太阴肺经的腧穴（A错）。曲池为手阳明大肠经的腧穴（C错）。少海为手少阴心经的腧穴（D错）。支沟为手少阳三焦经的腧穴（E错）。